取得执业助理医师执业证书后，具有高等学校医学专科学历的，可以在医疗预防保健机构中工作满一定年限后报考执业医师资格考试，该年限是
A. 3年
B. 5年
C. 1年
D. 4年
E. 2年

正确答案：E。2年

解析：据《执业医师法》和相关规定，取得执业助理医师执业证书后，具有高等学校医学专科学历（是指省级以上教育行政部门认可的各类高等学校医学专业专科学历）的，可以在医疗预防保健机构中工作满2年（E对）后报考执业医师资格考试。